男，14岁，右大腿深部巨大血管瘤，术后情况良好，伤口一期愈合。拆线后下床活动5分钟后，突然晕倒，抢救无效死亡。应考虑
A. 脑血管意外
B. 心肌梗死
C. 休克致死
D. 肺动脉栓塞
E. 脂肪栓塞

正确答案：D。肺动脉栓塞

解析：青少年男性患者，接受右大腿深部巨大血管瘤切除术，术后需卧床并制动，下肢静脉血流缓慢，容易产生深静脉血栓。拆线后下床活动可引起血栓脱落，血栓循下腔静脉→右心房→右心室→肺动脉，引起急性肺动脉栓塞（D对），导致患者死亡。患者仅14岁，且无高血压及冠心病等基础疾病，因而发生脑血管意外（A错）、心肌梗死（B错）可能性较小。休克常分为低血容量性、感染性、过敏性、心源性和神经性休克五类，题干并未提示患者存在可导致以上几种休克的诱因（C错）。脂肪栓塞（E错）常见于长骨骨折、严重脂肪组织挫伤或脂肪肝挤压，且多见于创伤早期。